尊重患者知情同意权，其正确的做法是
A. 婴幼儿可以由监护人决定其诊疗方案
B. 家属无承诺，即使患者本人知情同意也不得给予手术
C. 对特殊急诊患者的抢救都同样对待
D. 无须做到患者完全知情
E. 只经患者同意即可手术

正确答案：A。婴幼儿可以由监护人决定其诊疗方案

解析：知情同意权的主体，一是成年患者本人：具有完全民事行为能力的患者，应是知情同意权的主体；二是法律代理人：对于未成年的患者，知情同意权的主体是其父母或法定监护人（A对）；对于精神病患者、神志不明的患者，知情同意权的主体是其配偶、父母、成年子女和其他亲属等。家属无承诺，但具有完全民事行为能力的患者本人知情同意可以给予手术（B错）。对特殊急诊患者应尽快抢救（C错）。具有完全民事行为能力的患者，应做到患者完全知情（D错）。对于不具备完全民事行为能力的未成年患者及精神病患者，需法定监护人知情同意方可手术（E错）。